下列有关牙龈出血指数的描述中，不正确的一项是
A. 能反映龈炎的活动状况
B. 采用视诊和探诊相结合的方法
C. 只检查指数牙
D. 检查前一般不能检查菌斑指数
E. 记分为探查后牙龈出血部位的数目占总的检查部位数目的百分比

正确答案：C。只检查指数牙

解析：牙龈出血指数（GBI）于1975年由Ainamo和Bay提出，并认为牙龈出血情况更能反映龈炎的活动状况。GBI采用视诊和探诊相结合的方法检查全部牙或指数牙。每个牙检查唇（颊）面的近中、正中、远中3点和舌（腭）正中4个点。检查时使用牙周探针轻探牙龈，观察出血情况。检查牙龈出血指数前，一般不能检查菌斑指数，因使用染色剂后会影响牙龈出血情况的辨别。每个受检者的记分是探查后牙龈出血部位的数目占总的检查部位数目的百分比。掌握“牙周病流行病学及分级预防”知识点。